乙琥胺临床用于治疗
A. 抑郁症
B. 失眠
C. 惊厥
D. 癫痫小发作
E. 帕金森病

正确答案：D。癫痫小发作

解析：本题考查乙琥胺的临床应用。乙琥胺是癫痫小发作的首选药，疗效好，不良反应少。